诊断邻面龋最准确的方法是
A. 视诊
B. 探诊
C. 温度刺激试验
D. 染色法
E. 咬合翼片

正确答案：E。咬合翼片

解析：本题考查诊断邻面龋最准确的方法。咬合翼片（E对）可用于检查邻面龋和继发龋，有助于了解龋坏的部位和范围。邻面龋一般位于牙齿邻接部位，位置隐蔽，且邻面早期龋损着色较浅多为白垩色，视诊一般难以发现（A错）；早期的邻面龋损，龋洞尚未形成，探诊难以发现（B错）。牙髓温度测验是根据患牙对冷热刺激的反应来判断牙髓状态的一种方法，对牙髓病和根尖周病的诊断非常重要（C错）。染色法常用于牙隐裂的检查（D错）。